全口义齿取模前上颌托盘的宽度应比上颌牙槽嵴宽
A. 1mm
B. 2mm
C. 1～2mm
D. 2～3mm
E. 3mm

正确答案：D。2～3mm

解析：取模前的准备：调整体位、选择托盘。上颌托盘的宽度应比上颌牙槽嵴宽2～3mm。掌握“无牙颌的印模与模型”知识点。